动脉粥样硬化及冠心病患者的膳食原则不包括
A. 每日食盐摄入在10g左右
B. 保证充足的膳食纤维
C. 限制总能量摄入
D. 限制脂肪的摄入
E. 提高植物性蛋白的摄入

正确答案：A。每日食盐摄入在10g左右

解析：动脉粥样硬化患者的膳食原则包括：保证充足的膳食纤维（B对），提高植物性蛋白的摄入（E对），限制总能量摄入（C对），限制脂肪的摄入（D对）以预防肥胖。每人每日食盐量以不超过6g（A错，为本题正确答案）为宜，以预防高血压（P252）。